胃溃疡的主要发病机制是
A. 胃黏膜屏障受损
B. 胃黏膜免疫屏障破坏
C. 迷走神经功能亢进
D. 胃泌素增加
E. 前列腺素合成减少

正确答案：A。胃黏膜屏障受损

解析：胃溃疡在发病机制上以黏膜屏障防御功能降低（A对）为主要机制，十二指肠溃疡则以高胃酸分泌起主导作用。胃粘膜免疫屏障破坏（B错）多见于慢性胃炎，体内出现针对壁细胞或内因子的自身抗体，易诱发巨幼细胞贫血，称之为恶性贫血。迷走神经功能亢进、胃泌素升高（CD错）可使胃酸水平增高，间接导致十二指肠溃疡。前列腺素合成减少（E错）为急性胃炎的发病机制，通过非甾体类抗炎药物抑制环氧化酶的作用，进而减少了前列腺素的合成。